结缔组织和上皮组织替代肉芽组织拔牙后
A. 3～6个月
B. 3～4天
C. 5～8天
D. 24～35天
E. 38天以后

正确答案：B。3～4天

解析：结缔组织和上皮组织替代肉芽组织拔牙后3～4天，更成熟的结缔组织开始替代肉芽组织，至20天左右基本完成。掌握“牙拔除术前准备、器械、心血管及拔牙愈合过程”知识点。